休克肺时最早出现的酸碱失衡类型
A. 呼吸性酸中毒
B. 混合性酸中毒
C. 呼吸性碱中毒
D. AG正常性代谢性酸中毒
E. AG升高性代谢性酸中毒

正确答案：C。呼吸性碱中毒

解析：休克肺时最早出现的酸碱失衡类型是呼吸性碱中毒（C对ABDE错）。在休克早期，创伤、出血、感染等刺激可引起呼吸加深加快，通气量增加，PaC02 下降，导致呼吸性碱中毒。